饮水中氯化羟基呋喃酮（MX）的污染主要来源于
A. 汽车废气
B. 饮水氯化消毒
C. 装饰和建筑材料
D. 垃圾焚烧
E. 污染的化妆品

正确答案：B。饮水氯化消毒

解析：本题考查饮水中氯化羟基呋喃酮（MX）的污染主要来源。饮水中氯化羟基呋喃酮（MX）的污染主要来源于氯化消毒（B对ACDE错）。研究表明，MX在氯化消毒的饮水中浓度很低，一般为2～67ng/L，但却有极强的遗传毒性和致癌作用，被认为是迄今为止最强的诱变物之一。